九味羌活汤和羌活胜湿汤共同功效
A. 祛风湿止泻
B. 祛风湿止痛
C. 袪风胜湿淸热
D. 祛风胜湿化痰
E. 祛风湿，补肝肾

正确答案：B。祛风湿止痛

解析：九味羌活汤的功用发汗祛湿，兼清里热，羌活胜湿汤的功用祛风，胜湿，止痛。两方中均有羌活，羌活的功效是祛风湿，利关节，止痹痛。九味羌活汤和羌活胜湿汤均可祛风湿止痛（B对）。两方的鉴别，九味羌活汤解表之力较羌活胜湿汤为著，且辛散温燥之中佐以寒凉清热之品；羌活胜湿汤善祛一身上下之风湿，而解表之力较弱。